其分子结构中具氧环的是
A. 小檗碱
B. 麻黄碱
C. 伪麻黄碱
D. 东莨菪碱
E. 山莨菪碱

正确答案：D。东莨菪碱

解析：本题考查的是生物碱碱性强弱与分子中空间效应的关系。分子结构中具氧环的是东莨菪碱（D对）。生物碱碱性强弱与分子中空间效应的关系：若生物碱氮原子附近取代基存在空间立体障碍，不利于其接受质子，则生物碱的碱性减弱。例如，甲基麻黄碱分子结构中氮原子上较麻黄碱（B错）多一个甲基，甲基虽为供电子基，但由于空间位阻作用，其碱性较麻黄碱弱。东莨菪碱分子结构中氮原子附近较莨菪碱多一个6，7位环氧基，对氮原子产生显著的空间阻碍，其碱性较莨菪碱弱。山莨菪碱（E错）分子中的6-OH对氮原子接受质子也产生立体阻碍，但不及东莨菪碱的氧环影响大，故其碱性介于东莨菪碱与莨菪碱之间。利血平分子结构中有两个氮原子，其中时吲哚氮几乎无碱性，另一个脂叔胺氮因受C-19、C-20竖键的空间障碍影响，故利血平的碱性较弱。小檗碱（A错）属季铵型生物碱，由两个异喹啉环稠合而成，可离子化而呈强碱性。伪麻黄碱（C错）为有机仲胺衍生物，碱性较强。由于伪麻黄碱的共轭酸与C₂-OH形成分子内氢键，稳定性大于麻黄碱。所以伪麻黄碱的碱性稍强于麻黄碱。